火的特性是
A. 曲直
B. 稼穑
C. 从革
D. 炎上
E. 润下

正确答案：D。炎上

解析：本题考查五行的特性，属于理解记忆内容。采用取象比类和推演络绎的方法，火的特性。“火曰炎上”：“炎”，是焚烧、炎热、光明之义；“上”，是上升。炎上，是指火具有炎热、上升、光明的特性。引申为凡具有温热、上升、光明等性质或作用的事物和现象，归属于火（D对）。